女，35岁，初产妇。妊娠36周，血压升高1个月，持续腹痛伴阴道少量流血3小时。查体：T36℃，P120次/分，R28次/分，BP90/60mmHg，神志清楚，全身水肿。子宫硬如板状，胎方位不清，胎心未闻及，宫口2cm，先露-2cm.该患者最可能发生的并发症是
A. 心力衰竭
B. 子痫
C. HELLP综合征
D. DIC
E. 产褥感染

正确答案：D。DIC

解析：胎盘早剥的并发症包括：胎儿宫内死亡、弥散性血管内凝血（DIC）（最常见）（D对）、产后出血、急性肾衰竭和羊水栓塞。心力衰竭（A错）常由妊娠合并心脏病引起；子痫（B错）常由妊娠期高血压疾病引起；HELLP综合征（C错）的主要病理改变与妊娠期高血压疾病相同，以溶血、肝酶升高及血小板减少为特点，可能与自身免疫机制有关（P71）；产褥感染（E错）常见于胎膜早破、羊膜腔污染、产科手术、产程延长和产前产后出血等情况。产褥感染与产科出血、妊娠合并心脏病及严重的妊娠期高血压疾病，是导致孕产妇死亡的四大原因，并不属于胎盘早剥的并发症。